男，30岁，肝区钝痛低热乏力3个月，有血吸虫疫水接触史，偶饮酒。查体：肝肋下2cm，质硬。HBsAg（+），ALT60U，A/G3.1/3.0，AFP先后检测二次，结果分别为200ng/ml和400ng/ml。诊断首先应考虑
A. 慢性活动性肝炎
B. 肝炎肝硬化
C. 血吸虫病性肝纤维化
D. 酒精性肝硬化
E. 肝炎肝硬化合并原发性肝癌

正确答案：E。肝炎肝硬化合并原发性肝癌

解析：青中年男性患者，肝区钝痛（肝癌最常见的症状）、低热、乏力3个月，有血吸虫疫水接触史（血吸虫可导致肝硬化与肝癌）。查体：肝大，质硬（符合肝癌体征）。HBsAg（+），ALT60U（参考值为0～40U），提示轻度升高。A/G3.1/3.0，AFP先后检测二次，结果分别为200ng/ml和400ng/ml。，肝区钝痛、低热、乏力3个月，有血吸虫疫水接触史，偶饮酒。查体：肝大，质硬，HBsAg（+），肝功能减退，AFP为200ng/ml和400ng/ml，ALT和AFP曲线分离。诊断首先应考虑肝炎肝硬化合并原发性肝癌（E对）。慢性活动性肝炎可有低热、乏力、肝区不适，实验室检查：HBsAg（+），ALT增高，或ALT于AFP动态曲线平行或同步升高，或ALT持续增高至正常的数倍（A错）。血吸虫肝纤维化和肝炎肝硬化临床表现为肝功能减退和门静脉高压，实验室检查：ALT增高，A/G降低或倒置，AFP不增高（BC错）。酒精性肝病（P393）AST通常比ALT升高明显，但本患者AST升高不明显因此不作为首选诊断（D错）。